引发“痛痹”的病邪是
A. 风邪
B. 寒邪
C. 暑邪
D. 湿邪
E. 火邪

正确答案：B。寒邪

解析：痛痹是指痹证中以关节冷痛为主者。寒邪伤人，易致气血津液凝结，经脉阻滞，不通而痛，寒邪为最易导致疼痛的外邪，即寒邪致病致病易成“痛痹”（B对）。风邪致病最易形成行痹（A错）。湿邪致病易形成着痹（D错）。